藿胆丸的功能是
A. 滋肾平肝
B. 清热化湿，健脾止泻
C. 清热解毒，消肿止痛
D. 利咽开音，化痰散结
E. 芳香化浊，通鼻窍，去肝胆之火

正确答案：E。芳香化浊，通鼻窍，去肝胆之火

解析：本题考查的是藿胆丸的功能。藿胆丸的功能是芳香化浊，通鼻窍，去肝胆之火（E对）。藿胆丸：【功能】芳香化浊，清热通窍。耳聋左慈丸：【功能】滋肾平肝（A错）。小儿泻速停颗粒：【功能】清热利湿，健脾止泻（B错），缓急止痛。鼻炎康片：【功能】清热解毒，宣肺通窍，消肿止痛（C错）。黄氏响声丸：【功能】疏风清热，化痰散结，利咽开音（D错）。